某县城有6所小学，5所初中和3所高中：所属乡镇有10所中心小学，24所村小学和6所初中。该县疾病预防控制中心学校卫生科为了观察本县学生的生长发育动态拟开展调查。应该采取的抽样方法是
A. 随机抽样
B. 系统抽样
C. 整群抽样
D. 分层抽样
E. 多级式抽样

正确答案：E。多级式抽样